蛋白质一级结构是
A. β-折叠
B. 氨基酸侧链基团
C. 亚基
D. 氨基酸排列顺序
E. 氢键

正确答案：D。氨基酸排列顺序